患者，男，右侧腮腺区反复肿胀3年，腮腺区发胀，口内时有咸味。下列哪项较符合慢性阻塞性腮腺炎的病史
A. 患者夜间疼痛加重
B. 肿胀消长与进食有关
C. 无自觉症状
D. 耳前放射痛
E. 患者面颊麻木

正确答案：B。肿胀消长与进食有关

解析：本题考查慢性阻塞性腮腺炎。患者常不明确起病时间，多因腮腺反复肿胀而就诊。约占半数患者肿胀与进食有关（B对）；发作次数变异较大，多者每次进食都肿胀，少者1年内很少发作，大多平均每月发作一次以上。